下列哪项是正确的
A. 疾病监测属于描述性研究，而不属于疾病的预防控制工作
B. 三级预防是针对疾病自然史的不同阶段现时相应地采取不同的措施
C. 一级预防只能消除或减少机体对病因的暴露，而不具有对机体提供特异性保护的措施
D. 二级预防不包括临床诊断和临床治疗
E. 三级预防只能提供对症治疗，而不能提供康复治疗

正确答案：B。三级预防是针对疾病自然史的不同阶段现时相应地采取不同的措施

解析：本题考查预防策略。三级预防是针对疾病的不同阶段，在目标人群按照三个等级采取相应的公共卫生分级预防措施（B对）。第一级预防又称病因预防，是在疾病（或伤害）尚未发生时针对病因或危险因素采取措施（C错），降低有害暴露的水平，增强个体对抗有害暴露的能力，预防疾病（或伤害）的发生，或至少推迟疾病的发生。第二级预防又称“三早“预防，即早发现、早诊断、早治疗（D错）。第三级预防又称临床预防或疾病管理，发生在疾病的症状体征明显表现出来之后。早期，通过适当的治疗缓解症状，预防疾病进一步恶化，预防急性事件的发生和复发，预防合并症和残疾的发生。到了疾病晚期，通过早期发现和管理合并症，对已经发生的残疾进行康复治疗（E错），最大限度的恢复个体的机体功能和社会功能，提高生活质量，延长寿命。疾病监测属于描述性研究，也属于疾病的预防控制工作（A错）。